甲状腺素对下列哪个器官的发育最为重要
A. 肝和肾
B. 肾和心
C. 骨和脑
D. 肝和脑
E. 心和脑

正确答案：C。骨和脑

解析：甲状腺激素是促进神经系统发育最重要的激素，也可刺激骨化中心发育成熟，加速软骨软化，促进长骨和牙齿生长，因此甲状腺素对骨和脑的发育最为重要（C对）。